性寒，腹泻水逐饮，又消肿散结的药是
A. 巴豆
B. 大黄
C. 芫花
D. 甘遂
E. 千金子

正确答案：D。甘遂

解析：本题考查的是甘遂的性味归经与功效。性寒，腹泻水逐饮，又消肿散结的药是甘遂（D对）。甘遂：【性味归经】苦、甘，寒。有毒。归肺、肾、大肠经。【功效】泻水逐饮，消肿散结。巴豆（A错）：【性味归经】辛，热。有大毒。归胃、大肠、肺经。【功效】泻下冷积，逐水退肿，祛痰利咽，蚀疮去腐。大黄（B错）：【性味归经】苦，寒。归脾、胃、大肠、肝、心经。【功效】泻下攻积，清热泻火，解毒止血，活血祛瘀。芫花（C错）：【性味归经】辛、苦，温。有毒。归肺、肾、大肠经。【功效】泻水逐饮，祛痰止咳。外用杀虫疗疮。千金子（E错）：【性味归经】辛，温。有毒。归肝、肾、大肠经。【功效】泻水逐饮，破血消癥。